属于烷化剂抗癌药物是
A. 卡铂
B. 环磷酰胺
C. 氟尿嘧啶
D. 丝裂霉素
E. 长春新碱

正确答案：B。环磷酰胺

解析：烷化剂可影响DNA结构与功能，包括氮芥类（氮芥、环磷酰胺和异环磷酰氨、美法仑、苯丁酸氮芥）、亚硝脲类（卡莫司定、罗莫司丁）、乙烯亚胺类和烷基磺酸酯类（塞替派、白消安）。环磷酰胺（B对）是烷化剂，具有较广的抗瘤谱，可用于淋巴瘤、乳腺癌、卵巢癌、睾丸癌等。卡铂（A错）是铂类化合物，通过影响DNA结构和功能而发挥抗肿瘤作用。氟尿嘧啶（C错）是嘧啶拮抗剂抗肿瘤药物，主要用于治疗实体瘤，如结肠直肠癌、乳腺癌、卵巢癌等。丝裂霉素（D错）是破坏DNA的抗生素，主要与其他药物联合用于霍奇金病、费霍奇金病和睾丸癌。长春新碱（E错）是干扰蛋白质合成和功能的药物，一般与其他化疗药物合用，用于治疗儿童急性淋巴细胞白血病、肾母细胞瘤、尤因肉瘤等。